患者，女，40岁。风心病5年，近半月来胃纳差，恶心，呕吐，肝区疼痛，尿少。查体：颈静脉怒张，心尖区可闻及舒张期杂音，三尖瓣区可闻及收缩期杂音，肝肋下2cm。应首先考虑的是
A. 肝炎
B. 右心衰竭
C. 左心衰竭
D. 肝硬化
E. 全心衰竭

正确答案：B。右心衰竭

解析：患者中年女性，有风心病病史，心尖区可闻及舒张期杂音（二尖瓣狭窄的典型杂音），近半月来胃纳差伴恶心、呕吐（右心衰竭时常见的消化道症状），肝区疼痛（右心衰竭时肝淤血常伴压痛），查体：颈静脉怒张（右心衰竭常见体征），三尖瓣区可闻及收缩期杂音（右心室扩大引起），肝肋下2cm（提示肝大），综合患者的病史、临床变现和查体，应首先考虑的是二尖瓣狭窄导致的右心衰竭（B对）。肝炎（A错）常有食欲减退、腹胀、厌油腻食物、恶心、呕吐等症状，部分患者可出现肝掌和蜘蛛痣。左心衰竭（C错）和全心衰竭（E错）常出现不同程度的呼吸困难如劳力性呼吸困难、夜间阵发性呼吸困难，且双肺多可闻及湿性啰音。肝硬化（P421）（D错）多有食欲减退、恶心、厌食，营养不良，黄疸等肝功能减退表现，且常有腹水、食管胃底静脉曲张、脾大等门静脉高压表现。